服从Poisson分布，需满足哪些条件
A. 普通性
B. 平稳性
C. 独立增量性
D. 以上都是
E. 以上都不是

正确答案：D。以上都是